初产妇第一产程活跃期延长是指活跃期超过
A. 8小时
B. 12小时
C. 10小时
D. 4小时
E. 6小时

正确答案：A。8小时

解析：根据八版妇产科学和3版实用妇产科学：活跃期延长为活跃期超过8小时称为活跃期延长（A对）。根据九版妇产科学：活跃期宫颈口扩张速度＜0.5cm/h称为活跃期延长。